反映机体总的接触量和负荷宜采用
A. 生物监测
B. 环境监测
C. 防护设施效果评价
D. 医学检查
E. 生物效应监测

正确答案：A。生物监测